既养胃生津，又明目强腰的药是
A. 肉苁蓉
B. 山药
C. 何首乌
D. 石斛
E. 麦冬

正确答案：D。石斛

解析：本题考查的是补虚药石斛的功效。既养胃生津，又明目强腰的药是石斛（D对）。石斛：【功效】养胃生津，滋阴除热，明目，强腰。肉苁蓉（A错）：【功效】补肾阳，益精血，润肠通便。山药（B错）：【功效】益气养阴，补脾肺肾，固精止带。何首乌（C错）：【功效】补益精血，解毒，截疟，润肠通便。麦冬（E错）：【功效】润肺养阴，益胃生津，清心除烦，润肠通便。